女，35岁。1年前出现左眼睑下垂、视物成双，伴四肢无力，休息后减轻，疲劳后加重。半年前出现右眼睑下垂，伴饮水呛咳、声音嘶哑。该病产生的机制是
A. 终板膜因胆碱酯酶失活而持续去极化
B. 神经-骨骼肌接头处乙酰胆碱释放减少
C. 终板膜上的乙酰胆碱受体受到破坏
D. 骨骼肌肌膜上的电压门控Na⁺通道失活
E. 运动神经末梢电压门控Ca²⁺通道失活

正确答案：C。终板膜上的乙酰胆碱受体受到破坏

解析：中年女性患者，1年前出现左眼睑下垂、视物成双，伴四肢无力，休息后减轻，疲劳后加重。半年前出现右眼睑下垂，伴饮水呛咳、声音嘶哑。综合患者的症状、体征，初步诊断为重症肌无力，该病的发病机制是终板膜上的乙酰胆碱受体受到破坏（C对）。终板膜因胆碱酯酶失活而持续去极化（A错）可致肌强直。重症肌无力患者神经-骨骼肌接头处乙酰胆碱释放正常（B错）。骨骼肌肌膜上的电压门控Na⁺通道失活（D错）、运动神经末梢电压门控Ca²⁺通道失活（E错）均不是重症肌无力的发病机制。